以下不属于健康促进策略范畴的是
A. 健康教育
B. 健康保护
C. 健康管理
D. 政策立法
E. 环境干预

正确答案：C。健康管理

解析：本题考查健康促进策略范畴。健康促进是增强人们控制影响健康的因素，改善自身健康的能力的过程。它是一个综合的社会和政治活动过程，不仅包括直接加强个体行为和生活技能的健康教育，使人们知道如何保持健康；还包括通过政策、立法、经济手段和其他形式的环境工程，改善社会、经济和环境条件以减少它们对大众和个体健康的不利影响的社会行动，从而营造社会支持性的环境，促使人们实施维护和改善健康的行为。健康教育（A对）、健康保护（B对）、政策立法（D对）、环境干预（E对）都属于健康促进策略范畴。健康管理（C错，为本题正确答案）是对个人或人群的健康危险因素进行全面监管的过程，不属于健康促进策略范畴。